某医院收入一名哮喘患儿，在该患儿入院后的第2天发现其同时患有腮腺炎，如果该患儿在此次住院期间导致病房其他患儿感染腮腺炎，则这种感染应属于
A. 带入感染
B. 交叉感染
C. 医源性感染
D. 自身感染
E. 内源性感染

正确答案：A。带入感染